主要重性精神病
A. 严重遗传性疾病、指定传染病、重性精神病和重要脏器疾病
B. 由遗传因素先天形成，患者全部或部分丧失自主生活能力，子代再现风险高，医学上认为不宜生育的遗传性疾病
C. 艾滋病、淋病、梅毒、麻风病以及医学上认为影响结婚和生育的其他传染病在传染期内
D. 指精神分裂症、躁狂抑郁型精神病以及其他重型精神病在发病期间
E. 重要脏器疾病伴有明显功能不全阶段，医学上认为结婚和生育可能导致母婴严重后果者

正确答案：D。指精神分裂症、躁狂抑郁型精神病以及其他重型精神病在发病期间

解析：本题考查主要重性精神病的相关内容。重性精神病是指精神分裂症、躁狂抑郁型精神病以及其他重型精神病在发病期间（D对ABCE错），导致患者自制力和日常生活能力严重受损，无法与现实社会相接触，并伴随幻觉、妄想、行为古怪、思维怪异等表现。